氯霉素的主要不良反应有
A. 不可逆的再生障碍性贫血
B. 治疗性休克
C. 抑制婴儿骨骼生长
D. 对早产儿和新生儿可引起循环衰竭
E. 耳毒性

正确答案：A、B、D。不可逆的再生障碍性贫血；治疗性休克；对早产儿和新生儿可引起循环衰竭

解析：本题考查药物化学结构与第Ⅱ相生物转化的规律。氯霉素的不良反应有：1、血液系统异常：氯霉素可引起骨髓抑制，可能引起白细胞和血小板减少，甚至导致再生障碍性贫血（A对）。2、灰婴综合征：临床表现为腹胀、呕吐、进行性苍白、紫绀、微循环障碍（D对）、体温上升、呼吸不规则。3、周围神经炎和视神经炎：常在长期用药时发生。4、消化道反应：可出现腹泻、恶心、呕吐等。大量应用氯霉素治疗伤寒时会引起治疗性休克（B对） 5、过敏反应：较少见。一般较轻，停药后可迅速好转。6、二重感染：可导致变形杆菌、铜绿假单胞菌、真菌等引起的肺、胃肠道及尿路感染。氯霉素不会抑制婴儿的骨骼生长（C错），不会引起耳毒性（E错）。